对机械性刺激最为敏感的是
A. 逆行性牙髓炎
B. 残髓炎
C. 牙本质敏感
D. 可复性牙髓炎
E. 慢性增生性牙髓炎

正确答案：C。牙本质敏感

解析：牙本质敏感表现为激发痛。以机械刺激最为显著，其次为冷、酸、甜等，刺激除去后疼痛立即消失。掌握“残髓炎及逆行性牙髓炎”知识点。